易入血分，可聚于局部，腐蚀血肉，发为痈肿疮疡的邪气是
A. 风
B. 湿
C. 寒
D. 火
E. 燥

正确答案：D。火

解析：火热之邪入于血分，聚于局部，腐蚀血肉，而发为疮疡痈肿（D对）。风邪致病（A错）特点是风性轻扬开泄，易袭阳位；风性善行而数变；风性主动；风为百病之长长者。湿邪致病（B错）特点是湿为阴邪，易伤阳气；湿性重浊；湿性黏滞，易阻气机；湿性趋下，易袭阴位。寒邪致病（C错）特点是寒为阴邪，易伤阳气；寒性凝滞凝滞，易使气血津液凝结、经脉阻滞；寒性收引。燥邪致病（E错）特点是燥性干涩，易伤津液；燥易伤肺。